以滑膜炎为基本病理改变的风湿病是
A. 强直性脊柱炎
B. 类风湿关节炎
C. 风湿性关节炎
D. 骨性关节炎
E. 痛风性关节炎

正确答案：B。类风湿关节炎

解析：类风湿关节炎（B对）是以对称性多关节炎为主要临床表现的异质性、系统性、自身免疫性疾病，其基本病理改变是滑膜炎，急性期主要表现为渗出性和细胞浸润性滑膜炎。强直性脊柱炎（A错）主要表现为滑膜、关节囊、韧带或肌腱骨附着点的复发性非特异性炎症。风湿性关节炎（C错）主要表现为大关节的浆液性及纤维蛋白渗出性炎症。骨性关节炎（D错）主要表现为关节软骨变性。痛风性关节炎（E错）主要表现为关节滑囊内尿酸盐结晶沉淀而引起的炎症反应。